关于伤寒下列哪种说法不正确
A. 血培养阳性即可确诊
B. 肥达反应有辅助诊断意义
C. 血白细胞计数及分类有助于诊断
D. "vi"抗体的检测常用于慢性带菌者的调查
E. 粪便培养阳性即可确诊

正确答案：E。粪便培养阳性即可确诊

解析：Vi抗原其抗原性较弱，随着伤寒杆菌从人体中清除，Vi抗体滴度迅速下降以至消失，Vi抗体的检测有助于伤寒杆菌带菌者的筛查，因此，检测Vi抗体可用于慢性带菌者的调查（D对）；血培养是伤寒确诊的依据，第1～2周阳性率最高，再燃或复发亦可出现血培养阳性（A对）；肥达反应在病程中效价增高4倍以上有助于诊断（B对）；实验室检查外周血白细胞减少，嗜酸性粒细胞计数减少或消失（C对）。粪便培养从潜伏期开始即可阳性，病程第3～4周最高，但粪便中细菌较多，不可出现阳性就确诊为伤寒（E错，为本题正确答案）。